治湿痰壅肺之咳喘，常以陈皮配
A. 半夏
B. 佩兰
C. 砂仁
D. 枳壳
E. 木香

正确答案：A。半夏

解析：本题考查的是陈皮的配伍。治湿痰壅肺之咳喘，常以陈皮配半夏（A对）。陈皮：【配伍】陈皮配半夏：陈皮辛苦温，功能理气健脾、燥湿化痰；半夏辛温，功能燥湿化痰。两药相配，燥湿化痰力强，凡痰湿中阻、停肺均可择用。佩兰（B错）与广藿香配伍治湿浊中阻。广藿香：【配伍】广藿香配佩兰：广藿香微温，功能化湿和中、解暑、止呕，且兼发表；佩兰性平，功能化湿解暑。两药相配，尤善化湿和中、解暑、发表。凡湿浊中阻，无论兼寒兼热，也无论有无表证，均可投用。砂仁（C错）与木香（E错）配伍治湿滞、食积。砂仁：【配伍】砂仁配木香：砂仁性温，功能化湿行气温中；木香性温，功能理气调中止痛。两药相配，化湿、理气、调中止痛力胜，凡湿滞、食积，或夹寒所致的脘腹胀痛皆可投用。兼脾虚者，又当配伍健脾之品。枳壳（D错）：【主治病证】（1）脾胃气滞，脘腹胀满。（2）气滞胸闷。枳壳的配伍，2022年考试指南未明确说明。